呕吐伴寒战、发热、右上腹疼痛应考虑
A. 急性胰腺炎
B. 急性胆囊炎
C. 急性胃肠炎
D. 急性阑尾炎
E. 以上都不是

正确答案：B。急性胆囊炎

解析：急性胆囊炎（B对）是由于胆囊管阻塞和细菌侵袭而引起的胆囊炎症，其典型临床特征表现为呕吐伴寒战、发热、右上腹疼痛。急性胰腺炎（A错）引起中上腹疼痛，常伴有呕吐，严重者可出现休克。急性胃肠炎（C错）的疼痛部位与病变脏器的体表投影相符，一般不会伴发寒战、发热。急性阑尾炎（D错）是最常见的外科急腹症，以转移性右下腹痛及阑尾点压痛、反跳痛为其常见临床表现，可伴有恶心、呕吐，多数病人白细胞和嗜中性粒细胞计数增高，右下腹阑尾区（麦氏点）压痛，是该病的重要体征。